粒径小于3μm的被动靶向微粒，静注后的靶部位是
A. 骨髓
B. 肝、脾
C. 肺
D. 脑
E. 肾

正确答案：B。肝、脾

解析：本题考查被动靶向制剂。粒径是影响被动靶向制剂体内分布的首要因素。较大的微粒往往由于机械截留作用分布到相应组织，如粒径>7μm的微粒通常被肺部毛细血管截留，被单核细胞摄取进入肺组织或肺泡（C错）；而<7μm的微粒一般被肝、脾（B对）中的巨噬细胞吞噬而富集于这两个组织；100～200mm的微粒很快被巨噬细胞吞噬，最终富集于肝Kupffer细胞溶酶体中，而200～400mm的微粒集中于肝脏后迅速被清除；50～100mm的微粒可进入肝实质细胞中，<50mm的微粒可通过肝内皮细胞或通过淋巴传递到脾和骨髓（A错）中。